患者，男，28岁。肛门部剧痛2天，肛缘可扪及肿物，表面色紫，触痛明显。应首先考虑的是
A. 肛裂
B. 肛旁皮下脓肿
C. 血栓性外痔
D. 肛管癌
E. 内痔嵌顿

正确答案：C。血栓性外痔

解析：血栓性外痔是指痔外静脉破裂出血，血积皮下而形成的血凝块，其特点是肛门部突然剧烈疼痛，并有暗紫色血块，患者临床表现及体征符合血栓性外痔诊断（C对）。肛裂表现为便鲜血，肛门疼痛剧烈，呈周期性，多伴有便秘，局部检查可见6点或12点处肛管有梭形裂口（A错）。肛旁皮下脓肿发生于肛门周围的皮下组织内，局部红、肿、热、痛明显，病变部位并非肛门（B错）。肛管癌表现为排便习惯改变，粪便变形，肛门疼痛，肛门瘙痒伴分泌物，在肛门部可看到突起包块或溃疡（D错）。内痔嵌顿表现为齿线上内痔脱出、嵌顿，疼痛时间较长，皮瓣水肿，痔核表面糜烂伴有感染时有分泌物和臭味（E错）。